不经过肝脏CYP450酶系代谢的药物是
A. 洛伐他汀
B. 瑞舒伐他汀
C. 辛伐他汀
D. 阿托伐他汀
E. 普伐他汀

正确答案：E。普伐他汀

解析：本题考查他汀类药物。不经过肝脏CYP450酶系代谢的药物是普伐他汀（E对）。洛伐他汀（A错）、辛伐他汀（C错）、阿托伐他汀（D错）被肝药酶CYP3A4代谢。瑞舒伐他汀（B错）被2C9/2C19代谢。